缓慢生长，病期较长，肿瘤间质常有玻璃样变，上皮成分稀少，常常浸润神经生长被称为圆柱瘤的肿瘤是
A. 恶性多形性腺瘤
B. 腺泡细胞癌
C. 黏液表皮样癌
D. 腺样囊性癌
E. 多形性低度恶性腺癌

正确答案：D。腺样囊性癌

解析：本题考查腺样囊性癌。缓慢生长，病期较长，肿瘤间质常有玻璃样变，上皮成分稀少，常常浸润神经生长被称为圆柱瘤的肿瘤是腺样囊性癌（D对）。腺样囊性癌又被称为圆柱瘤，生长缓慢，病期较长。此瘤为恶性肿瘤，侵袭性强，容易向神经、血管和骨呈浸润和破坏性生长，术后常有复发。